角切迹位于
A. 胃小弯
B. 胃大弯
C. 胃底与胃体交界处
D. 胃大弯与食管左侧交界处
E. 幽门与十二指肠之间

正确答案：A。胃小弯

解析：角切迹位于胃小弯(A对)最低点弯度的明显转折处。